发生哺乳期急性乳腺炎的主要病因是
A. 乳晕皮肤皲裂
B. 乳汁淤积细菌侵入
C. 乳腺组织发育不良
D. 乳汁分泌障碍
E. 乳腺囊性増生病

正确答案：B。乳汁淤积细菌侵入

解析：发生哺乳期急性乳腺炎的主要病因是乳汁淤积和细菌入侵（B对）。乳晕皮肤皲裂（A错）是细菌入侵的途径之一。乳腺组织发育不良（C错）、乳汁分泌障碍（D错）、乳腺囊性増生病（E错）均不是急性乳腺炎的主要病因。